根管充填的指征如下，除外
A. 无自觉症状
B. 根管内无渗出
C. 细菌培养阴性
D. 取出棉捻无臭物
E. 检查无异常所见

正确答案：C。细菌培养阴性

解析：本题考查根管充填的时机。根管充填的指征如下，除外细菌培养阴性（C错，为本题正确答案）。根管充填的目的是将清理成形的根管进行严密的充填以消除死腔，杜绝来自根尖及冠方的各种微渗漏，阻止外来微生物和污染物质的进入，从而创造一个有利于根尖疾病愈合的良好环境，促进根尖疾病的愈合和恢复；根管治疗可以分多次完成，也可以一次性完成治疗，选择合适的时机进行充填有无重要。细菌培养阴性代表没有细菌存在，一方面，在临床实际操作过程中要达到完全无菌是很难实现的；其次，根管充填无需做到完全无菌，一般是在无自觉症状（A对），无明显叩痛，棉捻干燥，根管内无渗出（B对），根管内无异味，取出棉捻无臭物（D对），无急性根尖周炎症状，检查无异常所见（E对）时即可充填。不必等到所有症状消失，也不一定等待瘘管完全愈合，反复的封药容易对根尖周造成更大刺激，根管充填后窦道通常会愈合。